随着青春期的发展，血中水平在白天也呈阵发性升高的是
A. 黄体生成素
B. 卵泡刺激素
C. 雌激素
D. 雄激素
E. 孕激素

正确答案：A。黄体生成素

解析：本题考查黄体生成素的相关内容。青春期即将开始时，女孩只是在夜间睡眠时血中水平黄体生成素有阵发性升高，升高次数不多，升高幅度也不大。青春期开始后，夜间血中水平黄体生成素阵发性升高的次数逐渐增多，升高的幅度也愈来愈大。随着青春期的发展，血中水平黄体生成素（A对BCDE错）在白天也呈阵发性升高，促卵泡激素水平亦上升。在青春期进程中，垂体分泌出愈来愈多的促卵泡激素及黄体生成素，对女孩卵巢的发育成熟起了十分重要的作用。